女，25岁，3个月前因工作失误受到领导批评，觉得脸上无光，觉得同事看不起她，在背后议论她，不好意思出门，耳边常有命令性幻听，查体：躯体及神经系统无阳性体征。改善目前较合理的药物治疗
A. 丙咪嗪
B. 氯硝西泮
C. 碳酸锂
D. 氯丙嗪
E. 氯丙咪嗪

正确答案：D。氯丙嗪

解析：该青年女性，3个月前觉得同事在背后议论她（关系妄想），耳边常有命令性幻听（听幻觉），不好意思出门（在妄想和幻觉的支配下表现的行为），躯体及神经系统无阳性体征，最可能诊断为精神分裂症，首选抗精神病药物治疗，故选用氯丙嗪（抗精神病药物）（D对）。丙咪嗪和氯丙咪嗪（氯米帕明）均为抗抑郁药，主要用于抑郁发作（AE错）。氯硝西泮主要用于控制癫痫（B错）。碳酸锂是最常用的心境稳定剂（抗躁狂药物），主要用于躁狂发作（C错）。